具有独特的细胞核多形性和核分裂，包括非正常核分裂，角化不常见，细胞间桥不显著等特点的为鳞癌中的
A. 高分化鳞癌
B. 成釉细胞癌
C. 中度分化鳞状细胞癌
D. 微浸润性鳞状细胞癌
E. 低分化鳞癌

正确答案：C。中度分化鳞状细胞癌

解析：中度分化鳞状细胞癌具有独特的核的多形性和核分裂，包括非正常核分裂，角化不常见，细胞间桥不显著。掌握“口腔黏膜鳞癌及疣状癌”知识点。